关于助溶机理的叙述，正确的有
A. 助溶剂与药物形成可溶性络合物
B. 助溶剂与药物形成可溶性有机分子复合物
C. 助溶剂与药物产生复分解反应而生成可溶性盐类
D. 助溶剂具有潜溶性
E. 助溶剂能形成胶团

正确答案：A、B、C。助溶剂与药物形成可溶性络合物；助溶剂与药物形成可溶性有机分子复合物；助溶剂与药物产生复分解反应而生成可溶性盐类